外源化学物联合作用的类型有
A. 相加作用
B. 协同作用
C. 拮抗作用
D. 独立作用
E. 以上都是

正确答案：E。以上都是